某男，57岁。自诉眩晕，动则加剧，常因劳累而加重，心悸少寐，入睡困难，神疲懒言，食欲不振，面色无华，舌淡，脉细弱。宜选用的中成药是
A. 半夏天麻丸
B. 左归丸
C. 养血安神丸
D. 归脾丸
E. 补中益气丸

正确答案：D。归脾丸

解析：本题考查的是眩晕的辨证论治。自诉眩晕，动则加剧，常因劳累而加重，心悸少寐，入睡困难，神疲懒言，食欲不振，面色无华，舌淡，脉细弱。宜选用的中成药是归脾丸（D对）。眩晕是以头晕、眼花为主症的疾病。轻者闭目即止，重者如坐车船，旋转不定，不能站立，或伴恶心、呕吐、汗出、面色苍白等症，甚则突然晕倒。西医学的耳性眩晕（梅尼埃病、耳石症、晕动病）、脑性眩晕（椎-基底动脉供血不足、脑动脉粥样硬化）、颈源性眩晕（椎动脉型颈椎病）以及其他原因（血压异常、神经症、眼部疾患及外伤等）所致眩晕，均可参考此处辨证论治。（一）肝阳上亢证：【症状】眩晕，耳鸣，头目胀痛，口苦，失眠多梦，遇烦劳郁怒而加重，颜面潮红，急躁易怒。舌红苔黄，脉弦或数。【中成药应用】常用中成药有天麻钩藤颗粒、松苓血脉康胶囊、复方罗布麻颗粒。（二）气血亏虚证：【症状】眩晕动则加剧，劳累即发，面色淡白，神疲乏力，倦怠懒言，唇甲不华，发色不泽，心悸少寐，纳少腹胀。舌淡苔薄白，脉细弱。【中成药应用】常用中成药有归脾丸（大蜜丸）、益中生血片、参茸阿胶。（三）肾精不足证：【症状】眩晕日久不愈，精神萎靡，两目干涩，视力减退，腰膝酸软，或遗精滑泄，耳鸣齿摇，颧红咽干，五心烦热。舌红少苔，脉细数。【中成药应用】常用中成药有左归丸（B错）、古汉养生精。（四）痰湿中阻证：【症状】眩晕，头重昏蒙，或伴视物旋转，胸闷恶心，呕吐痰涎，食少多寐。舌苔白腻，脉濡。【中成药应用】常用中成药有半夏天麻丸（A错）、眩晕宁颗粒、晕复静片。养血安神丸（C错）：【功能】滋阴养血，宁心安神。【主治】阴虚血少所致的头眩心悸、失眠健忘。补中益气丸（E错）为泄泻脾胃虚弱证的中成药应用。